男，41岁。刀刺伤右上腹1小时来诊，腹腔穿刺抽出不凝血，急诊手术探查，正确的腹腔探查顺序是首先探查
A. 胃十二指肠
B. 膈肌
C. 胃后壁及胰腺
D. 右肾
E. 肝脏

正确答案：E。肝脏

解析：青年男性患者，右上腹刀刺伤，腹腔穿刺抽出不凝血，提示腹部脏器损伤出血。急诊手术探查时，正确的探查次序为：先探查肝、脾、肾等实质性脏器，再探查膈肌（B错）、胆囊等，之后从胃开始，依次探查十二指肠第一段、空肠、回肠、大肠及其系膜（A错），然后探查盆腔脏器、胃后壁和胰腺（C错）；必要时，最后探查十二指肠二、三、四段。由于肝脏位置较浅，肾脏位置深在，因此，应首先探查肝脏（E对），而非右肾（D错）。